属于主动免疫治疗肿瘤的方法是
A. BCG注射
B. 抗原性疫苗的输入
C. IL-2的注射
D. 抗肿瘤导向治疗
E. LAK的输入

正确答案：B。抗原性疫苗的输入